男性，面部烫伤浅。肿胀明显2天，入院后最主要应观察
A. 神志
B. 呼吸
C. 脉搏
D. 尿量
E. 饮食状况

正确答案：B。呼吸

解析：因为是面部烫伤，入院时有肿胀，故观察重点为是否肿胀部位影响正常的呼吸。掌握“火器伤、热烧伤”知识点。